羊水过少是指妊娠晚期羊水量少于
A. 500ml
B. 400ml
C. 300ml
D. 200ml
E. 100ml

正确答案：C。300ml

解析：妊娠晚期羊水量少于300ml者，称为羊水过少（C对）。